健康城市是指
A. 从城市规划、建设到管理各个方面都以人的健康为中心
B. 营造高质量的自然环境和更加舒适的生活环境
C. 保障广大市民健康生活和工作
D. A＋B＋C
E. A＋B

正确答案：D。A＋B＋C

解析：本题考查健康城市。健康城市是在城市规划、建设、管理、服务等各个方面都以健康为中心，营造高质量的自然环境和更加舒适的生活环境，保障市民健康的生活和工作（D对ABCE错），成为健康人群、健康环境和健康社会有机结合的人类社会发展整体。